一小儿，身长76cm，体重9.5Kg，头围46cm，胸围46cm，出牙6颗。最可能的年龄是
A. 10个月
B. 15个月
C. 24个月
D. 12个月
E. 18个月

正确答案：D。12个月

解析：1岁小儿体重为10Kg，身高为75cm，头围为46cm，月龄=出牙+（4～6）=6颗+（4～6）=10～12月，综上所述，小儿可能的年龄是12月（D对）。